成骨肉瘤的X线表现是
A. 颌骨内虫蚀样骨质破坏
B. 颌骨多样囊腔影
C. 颌骨内多房低密度影，局部呈蜂窝状改变
D. 根尖周围性低密度影
E. 日光放射状骨增生

正确答案：E。日光放射状骨增生

解析：本题考查成骨肉瘤的X线表现。成骨肉瘤的X线表现是日光放射状骨增生（E对）。颌骨内虫蚀样骨质破坏是原发性骨内鳞状细胞癌的X线表现（A错）；颌骨多样囊腔影是牙源性角化囊性瘤的X线表现（B错）；颌骨内多房低密度影，局部呈蜂窝状改变是成釉细胞瘤蜂窝型的影像学表现（C错）；根尖周围性低密度影的疾病很多，例如根尖周囊肿、根尖周脓肿、根尖周肉芽肿等等，不能判断为成骨肉瘤的影像学表现（D错）；日光放射状骨增生和斑块状瘤骨，是成骨骨肉瘤的重要标志之一。